男，46岁。近3个月出现尿频、尿急，排尿迟缓、断续，既往体健，应采取的治疗措施
A. 观察等待
B. 药物治疗
C. 手术治疗
D. 激光治疗
E. 支架治疗

正确答案：A。观察等待